某冠心病患者想接受冠脉旁路移植治疗，但又担心术中出现意外，这属于
A. 双趋冲突
B. 双避冲突
C. 趋避冲突
D. 双重趋避冲突
E. 多重趋避冲突

正确答案：C。趋避冲突

解析：趋避冲突（C对）指一个人对一样事物又想得到又想避开的矛盾心理，文中的病人希望手术可以治好病，却又害怕手术出现意外，正是反映了他对手术又爱又怕的矛盾心理，符合趋避冲突的意思。双趋冲突（P33）（A错）指的是两个目标具有相同的吸引力，但只能二选一，比如鱼与熊掌不可兼得。双避冲突（P33）（B错）指的是一个人同时想避开两种事物的威胁，比如前有狼，后有虎的情况。双重趋避冲突（P33）（D错）是指人同时有多个目标，但是每个目标又各有利弊，无法选择，难以拿定主意的情况。